属于溶栓药的有
A. 重组链激酶
B. 尿激酶
C. 瑞替普酶
D. 纤维蛋白酶
E. 替奈普酶

正确答案：A、B、C、E。重组链激酶；尿激酶；瑞替普酶；替奈普酶

解析：本题考查溶栓药。溶栓药的分类：①非特异性纤溶酶原激活剂：尿激酶（B对）、重组链激酶（A对）。②人组织纤维蛋白溶酶原激活剂（t-PA）。③t-PA改构体或修饰体，代表药物有瑞替普酶（C对）、替奈普酶（E对）、拉诺替普酶等。④其他，如国内上市的重组尿激酶原。纤维蛋白酶（D错）是抗出血药。